关于药物表观分布容积的说法，正确的是
A. 药物表观分布容积是体内药量与血药浓度的比值
B. 表观分布容积是药物体内分布的真实容积
C. 水溶性大的药物往往表观分布容积大
D. 药物表观分布容积不能超过体液总体积
E. 表现分布容积反映药物在体内分布的快慢

正确答案：A。药物表观分布容积是体内药量与血药浓度的比值

解析：本题考查的是表观分布容积的名词解释。关于药物表观分布容积的说法，正确的是药物表观分布容积是体内药量与血药浓度的比值（A对）。表观分布容积是体内药量与血药浓度间关系的一个比例常数（B错），用V表示。表观分布容积的大小反映了药物的分布特性（E错）。通常，水溶性或极性大的药物，不易透过毛细血管壁，血药浓度较高，表观分布容积较小（C错）；亲脂性药物在血液中浓度较低，表观分布容积通常较大，往往超过体液总体积（D错）。